结缔组织外痔的主要症状是
A. 肛门坠胀
B. 肛周剧痛
C. 直肠黏膜脱出
D. 肛门异物感
E. 便意频数

正确答案：D。肛门异物感

解析：结缔组织性外痔是因慢性炎症的刺激、反复发作致肛缘局部皮肤纤维化、结缔组织增生，形成皮垂者，亦称赘皮外痔，主要以肛门部位坠胀感、异物感为主要的特征，还可能会出现肛门潮湿瘙痒（D对）。肛门坠胀常见于静脉曲张性外痔（A错）。肛周剧痛多由于肛门直肠刺激肛裂、肛门皲裂、肛门异物损伤，饮食辛辣刺激，导致肛门疼痛。此外外痔、内痔脱出伴有血栓形成，亦会导致肛门疼痛（B错）。直肠粘膜脱垂是一种常见的肛肠疾病，又称直肠脱垂，是指肛管直肠外翻而脱垂于肛门外。直肠粘膜松弛作为直肠粘膜脱垂的初期阶段，症状并不是很明显，无非就是排便异常、腹部下坠感强烈等，但是直肠粘膜松弛发展成为直肠粘膜脱垂后，就会出现脱出等症状。临床上，像内痔、外痔等很多疾病都可以导致直肠粘膜松弛的发病（C错）。直肠癌会出现直肠刺激症状：便意频繁，排便习惯改变，便前有肛门下坠感，便里急后重，排便不干净的感觉（E错）。